在小剂量时有抑制血栓形成作用的药物是
A. 阿司匹林
B. 布洛芬
C. 尼美舒利
D. 吡罗昔康
E. 保泰松

正确答案：A。阿司匹林

解析：本题考查阿司匹林。阿司匹林（A对）是不可逆性COX（环氧酶）抑制剂，较低剂量时抑制COX-1，减少TXA₂产生，抑制TXA₂诱导的血小板聚集，防止血栓形成。布洛芬（B错）为解热镇痛类药，通过抑制环氧化酶,减少前列腺素的合成,产生镇痛、抗炎作用。尼美舒利（C错）为非甾体抗炎药，可用于多种需要抗炎治疗的疾病。吡罗昔康（D错）用于治疗风湿性及类风湿性关节炎。保泰松（E错）用于类风湿性关节炎、风湿性关节炎及强直性脊柱炎。